男性，74岁，右侧腹股沟区可复性肿块8年，查体：病人直立时，在腹股沟内侧端、耻骨结节上外方有一4cm×4cm半球形肿物，未进入阴囊，平卧后自行消失。该病人最可能的诊断是
A. 股疝
B. 隐睾
C. 交通性鞘膜积液
D. 腹股沟斜疝
E. 腹股沟直疝

正确答案：E。腹股沟直疝

解析：老年男性患者，右侧腹股沟区可复性肿块8年（提示腹股沟疝），查体：病人直立时，在腹股沟内侧端、耻骨结节上外方有一半球形肿物，未进入阴囊，平卧后自行消失（腹股沟直疝的典型表现），结合患者病史、症状和体征，该病人最可能的诊断为右侧腹股沟直疝（E对）。股疝（A错）多见于40岁以上的女性，疝块往往不大，常在腹股沟韧带下方卵圆窝处表现为一半球形的突起，平卧回纳内容物后，疝块有时不能完全消失。隐睾症（B错）多见于小儿，触诊时不能触及睾丸。交通性鞘膜积液（C错）常表现为站立时缓慢出现并增大的肿块，平卧或睡觉后肿块逐渐缩小，透光试验阳性。腹股沟斜疝（D错）多见于儿童和青壮年，表现为腹股沟区有一突出的肿块，多呈带蒂柄的梨形，并可降至阴囊或大阴唇。用手按肿块并嘱患者咳嗽，可有膨胀性冲击感。